关于抗痛风药秋水仙碱的说法，正确的有
A. 初始剂量1mg维持剂量0.5mg，tid
B. 可用于痛风的长期预防
C. 可用于痛风的缓解期
D. 老年人、肝肾功能不全者应减量
E. 长期服用可导致可逆性维生素B₁₂吸收不良

正确答案：A、D、E。初始剂量1mg维持剂量0.5mg，tid；老年人、肝肾功能不全者应减量；长期服用可导致可逆性维生素B₁₂吸收不良

解析：本题考查秋水仙碱。秋水仙碱治疗痛风性关节炎的急性发作，预防复发性痛风性关节炎的急性发作（BC错）。用于急性期，初始剂1mg, 之后一次0.5mg, 一日3次（A对），最多每隔4小时给予1次，直至疼痛缓解或出现呕吐或腹泻，24小时最大剂量6mg。老年人、胃肠道疾病、心功能不全及肝肾功能有潜在损害者应减少剂量或慎用（D对）。长期服用导致维生素B₁₂吸收不良（E对），出现贫血的表现。